患者，女，27岁，已婚。停经46天，妊娠试验阳性，恶心呕吐，食入即吐，神疲思睡，舌淡苔白，脉滑缓，诊为妊娠恶阻。其证候是
A. 脾虚痰滞
B. 脾胃虚弱
C. 气阴两虚
D. 肝胃不和
E. 以上均非

正确答案：B。脾胃虚弱

解析：该患者停经46天，妊娠试验阳性，为怀孕早期，患者恶心呕吐，食入即吐，故诊断为妊娠恶阻。恶心呕吐，食入即吐为脾胃虚弱，升降失常，孕后阴血下聚养胎，冲气上逆犯胃，胃失和降所致。脾胃虚弱，中阳不振，清阳不升，故神疲思睡。舌淡苔白，脉滑缓为脾胃虚弱之征，故辨为脾胃虚弱证。脾虚痰滞者多伴胸闷泛恶，呕吐痰涎，舌苔多厚腻（A错）。题中辨为脾胃虚弱证（B对）。气阴两虚舌质多红，有气虚和阴虚的典型症状，且妊娠恶阻重症可见气阴两虚之象（C错）。肝胃不和证多伴呕吐酸水或苦水，恶油腻，口干口渴，胸满胁痛，嗳气叹息等（D错）。